患者，女，28岁，妊娠27周，头晕3天。入院查体：血压160/100mmHg，诊断为：妊娠高血压。该患者降压治疗应首选的药物是
A. 福辛普利
B. 卡托普利
C. 缬沙坦
D. 拉贝洛尔
E. 特拉唑嗪

正确答案：D。拉贝洛尔

解析：本题考查降压药。该患者降压治疗应首选的药物是拉贝洛尔（D对）。拉贝洛尔为妊娠高血压常用降压药物。福辛普利（A错）、卡托普利（B错）为ACEI类药物，缬沙坦（C错）为ARB类药物，均禁用于妊娠期妇女。特拉唑嗪（E错）可引起体位性低血压，头晕患者不宜选用。